醋炙柴胡的目的是
A. 助其发散，增强解表作用
B. 助其升浮，增强升阳作用
C. 助其升散，增强疏肝作用
D. 抑制浮阳，增强清肝作用
E. 引药入肝，增强滋阴作用

正确答案：C。助其升散，增强疏肝作用

解析：本题考查的是柴胡的炮制方法及作用。醋炙柴胡的目的是助其升散，增强疏肝作用（C对）。柴胡：【炮制作用】柴胡味辛、苦，性微寒。归肝、胆、肺经。具有疏散退热、疏肝解郁、升举阳气的功能。用于感冒发热，寒热往来，胸胁胀痛，月经不调，子宫脱垂，脱肛。①生品升散作用较强，多用于解表退热。②醋柴胡的升散之性缓和，疏肝止痛的作用增强。多用于肝郁气滞的胁肋胀痛，腹痛及月经不调等症。③鳖血柴胡能填阴滋血，抑制其浮阳之性，增强清肝退热（D错）的功效。可用于热入血室，骨蒸劳热。